固定性湿啰音
A. 支气管哮喘
B. 支气管扩张
C. 慢性阻塞性肺疾病
D. 支气管肺癌
E. 肺间质纤维化

正确答案：B。支气管扩张

解析：固定性湿啰音见于支气管扩张（B对）。支气管哮喘多数有广泛的呼气相为主的哮鸣音，呼气音延长（A错）。两肺散在干湿啰音伴哮鸣音及呼气延长见于慢性阻塞性肺疾病（C错）。支气管肺癌患者支气管狭窄可引起气体陷闭伴局限性哮鸣，常引起肺不张伴纵隔移位，肺膨胀度减少（D错）。肺间质纤维化早期患者可显示双下肺野的模糊如磨玻璃样密度增高阴影，提示肺泡性浸润性病变病理基础，为肺泡炎X线特征表现（E错）。